美国Framingham研究了各心血管疾病危险因素的回归系数，回归系数的大小表示联系的大小，则
A. 系数越大，联系越大，系数为正数、表示正相关，若为负数则为负相关
B. 系数越大，联系越小，若为正数表示负相关
C. 若为负数，表示正相关
D. 若系数为正数则有保护作用
E. 系数的大小与危险因素关系不大

正确答案：A。系数越大，联系越大，系数为正数、表示正相关，若为负数则为负相关